急性根尖炎黏膜下脓肿期最有效的治疗措施为
A. 服用消炎止痛药
B. 开髓引流
C. 切开排脓
D. 调（牙合）磨改
E. 针刺止痛

正确答案：C。切开排脓

解析：本题考查急性根尖炎黏膜下脓肿期的治疗措施。急性根尖炎黏膜下脓肿期脓肿成熟到达黏膜下，位置表浅。黏膜下组织较疏松压力减低，疼痛症状减轻，因此此时最有效的治疗措施为切开排脓（C对），可有效排脓，防止炎症扩散，并能减轻患者痛苦。服用消炎止痛药（A错）对慢性期牙髓炎和根尖周炎有一定镇痛效果，但对剧烈疼痛的处于黏膜下脓肿期的急性根尖炎效果不明显。开髓引流（B错）在急性根尖炎早期可以缓解髓腔高压，减轻患者剧痛，黏膜下脓肿形成后只有切开排脓才能迅速缓解胀痛。调（牙合）磨改（D错）可使患牙咬合降低、功能减轻、得以休息，但不能彻底消除疼痛的根源，脓液未引流还会出现胀痛感。针刺止痛（E错）对轻微疼痛的牙髓炎根尖周炎有一定效果，对缓解急性根尖炎黏膜下脓肿期疼痛效果不明显。